肝素过量，使用鱼精蛋白解救属于
A. 增强作用
B. 增敏作用
C. 脱敏作用
D. 诱导作用
E. 拮抗作用

正确答案：E。拮抗作用

解析：本题考查药物的相互作用。鱼精蛋白带有强大的阳电荷，能与带有强大阴电荷的的肝素形成稳定的复合物，使肝素的抗凝血作用消失，为化学性拮抗作用（E对）；增强作用（A错）是指药物联用使药效增强（A错）；增敏作用（B错）指某药可使组织或受体对另一药的敏感性增强；脱敏作用（C错）指某药可使组织或受体对另一药物的敏感性减弱；酶诱导效应（D错）指一些药物能增加肝微粒体酶的活性，加速药物代谢。